下列各项，不符合道德要求的是
A. 尽量为患者选择安全有效的药物
B. 要严格遵守各种抗生素的用药规则，尽可能开患者要求的好药，贵重药物
C. 尽可能开患者要求的好药，贵重药物.
D. 对婴幼患儿、老年患者的用药应该谨慎，防止肾功能损害
E. 钻研药理知识，防止粗疏和盲目用药

正确答案：C。尽可能开患者要求的好药，贵重药物.

解析：在诊治过程中，医生应依靠患者的病情尽量为患者选择安全有效且价格低廉的药物（A对），而不是开患者要求的好药、贵药（C错，为本题正确答案）。应严格掌握抗生素用药规则，避免过度使用抗生素（B对）。由于婴幼儿、老年人体质虚弱，故对婴幼患儿，老年病人的用药应该谨慎，防止肾功能损害（D对）。医生应钻研药理知识，防止粗疏和盲目用药（E对）。